肾小盏包绕的是
A. 肾盂
B. 肾静脉
C. 肾动脉
D. 肾乳头
E. 肾柱

正确答案：D。肾乳头

解析：肾小盏包绕的是肾乳头（D对）。